下列哪项不是被覆黏膜的特征
A. 无颗粒层
B. 无角化层
C. 上皮钉突短
D. 固有层界限不清
E. 无黏膜下层

正确答案：E。无黏膜下层

解析：本题考查口腔黏膜基本结构。咀嚼黏膜和特殊黏膜外的口腔黏膜均称被覆黏膜。黏膜表层无角化，富有弹性，可承受张力。上皮一般较咀嚼黏膜厚，结缔组织乳头短而粗，上皮与结缔组织交界面较平坦。被覆黏膜富有弹性，有一定的活动度，有较疏松的黏膜下层（E错，为本题正确答案）。